腮腺占分泌量的
A. 2%～4%
B. 7%～8%
C. 22%～30%
D. 60%～65%
E. 80%～90%

正确答案：C。22%～30%

解析：下颌下腺静止时分泌量最大，占60%～65%，腮腺占22%～30%。掌握“唾液的分泌和功能”知识点。